女，50岁，下楼梯时跌倒，左髋部剧烈疼痛，不能活动。经X线片检查见左股骨颈骨折，但断端相互嵌插，无明显移位，测pauwels角＜30°。其最佳治疗方法是
A. 切开复位内固定
B. 人工关节置换术
C. 转子间截骨术
D. 植骨或血管移植术
E. 持续皮牵引6～8周

正确答案：E。持续皮牵引6～8周

解析：中年女性患者，跌倒后左髋部疼痛、不能活动（提示可能为股骨颈骨折），X线片示左股骨颈骨折，断端相互嵌插，无明显移位，测Pauwels角＜30°（Pauwels角为远端骨折线与两侧髂嵴连线的夹角，外展型骨折Pauwels角＜30°，内收型骨折Pauwels角＞50°），结合患者病史、临床表现及实验室检查，患者应诊断为左股骨颈外展型骨折，属稳定性骨折。依据七版外科学（P779）教材，对于无明显位移、外展型或嵌入型等稳定性骨折，多采用非手术治疗，治疗方法包括穿防旋鞋，下肢皮肤牵引，卧床6～8周，同时进行股四头肌等长收缩训练和踝足趾的屈伸活动等。故该患者最佳治疗方法是持续皮牵引6～8周（E对）。切开复位内固定（A错）主要用于手法复位失败、固定不可靠及青壮年陈旧性骨折不愈合的病人。人工髋关节置换（B错）用于65岁以上老年人的股骨颈头下型骨折。转子间截骨术（C错）常用于股骨颈骨折不愈合的病人。植骨或血管移植术（D错）多用于骨组织较大缺损的疾病。